薏苡仁的原植物属于
A. 伞形科
B. 唇形科
C. 菊科
D. 禾本科
E. 姜科

正确答案：D。禾本科

解析：本题考查的是薏苡仁的来源。薏苡仁的原植物属于禾本科（D对）。薏苡仁：【来源】为禾本科植物薏苡的干燥成熟种仁。来源于伞形科（A错）的中药有当归、川芎、柴胡、白芷、羌活等。来源于唇形科（B错）的中药有丹参、黄芩、紫苏叶、广藿香、荆芥、益母草、薄荷、半枝莲、香薷等。来源于菊科（C错）的中药有木香、川木香、白术、苍术、紫菀、艾叶、款冬花、菊花、红花、牛蒡子、茵陈、青蒿、大蓟、蒲公英等。来源于姜科（E错）的中药有莪术、姜黄、郁金、砂仁、草果、豆蔻、草豆蔻、益智等。